男性，60岁，鼻咽癌术后放疗，放疗两次后口腔黏膜大面积溃烂，疼痛明显。该患者可能的诊断为
A. 白色念珠菌感染
B. 放射性口腔炎
C. 急性感染性口炎
D. 过敏性口炎
E. 接触性口炎

正确答案：B。放射性口腔炎

解析：本题考查放疗化疗性口腔黏膜炎。该患者放疗两次后出现口腔黏膜的溃疼痛，放射性口腔炎（B对）就是受到放射性电离辐射引起的口腔黏膜的充血、糜烂、溃疡，这是最可能的诊断。白色念珠菌感染（A错）是由于念珠菌感染引起的口腔黏膜病损，临床症状主要为口干、发粘、口腔黏膜烧灼感、疼痛、味觉减退。急性感染性口炎（C错）是由于急性感染引起的口腔黏膜的炎症。过敏性口炎（D错）、接触性口炎（E错）是由于超敏体质者的口腔黏膜接触变应原引发的口腔黏膜炎症性疾病。这几种病均无放射治疗史。